某食品公司开发一种新的婴幼儿食品，采用蛋白质功效比值方法评价蛋白质营养价值，实验为动物实验。实验饲料要求蛋白质含量
A. 0.05
B. 0.1
C. 0.15
D. 0.2
E. 0.25

正确答案：B。0.1